原始的纤维样骨替代结缔组织大约
A. 3～6个月
B. 3～4天
C. 5～8天
D. 24～35天
E. 38天以后

正确答案：E。38天以后

解析：原始的纤维样骨替代结缔组织大约38天以后，拔牙窝的2/3被纤维样骨质充填，3个月后才能完全形成骨组织。这种骨质密度较低，X线检查仍可看到牙槽窝的影像。掌握“牙拔除术前准备、器械、心血管及拔牙愈合过程”知识点。